在药品处方中，常作为水溶性包衣材料的是
A. 羧甲基纤维素钠（CMC-Na）
B. 羟丙基甲基纤维素（HPMC）
C. 乙基纤维素（EC）
D. 甲基纤维素（MC）
E. 羟丙基纤维素（HPC）

正确答案：D。甲基纤维素（MC）

解析：本题考查常用的辅料。在药品处方中，常作为水溶性包衣材料的是甲基纤维素（MC）（D对）。包衣的基本类型包括糖包衣、薄膜包衣和压制包衣等。薄膜包衣可用高分子包衣材料，包括胃溶型、肠溶型和水不溶型三大类。胃溶型主要有羟丙基甲基纤维素、甲基纤维素等；水不溶型包衣材料主要有乙基纤维素（EC）（C错）和醋酸纤维素；羧甲基纤维素钠（CMC-Na）（A错）为常用的亲水性凝胶骨架材料；羟丙基甲基纤维素（HPMC）（B错）、羟丙基纤维素（HPC）（E错）是常用的黏合剂。